复合树脂与牙釉质表面粘接的方式
A. 机械性锁合粘接
B. 化学性粘接
C. 机械性与化学性粘接
D. 固位洞形
E. 螯合

正确答案：A。机械性锁合粘接

解析：本题考查复合树脂与牙釉质表面粘接的方式。牙酸蚀后的牙釉质表面有微孔，粘接树脂进入，形成树脂突，多个树脂突交互相连，形成机械性锁合粘接（A对），这是复合树脂与牙釉质表面粘接的主要方式。化学性粘接（BC错）是粘接剂与复合树脂之间的连接方式。固位洞形（D错）是防止充填体在侧向或垂直方向力量作用下移位、脱落的形状，属于机械固位的一种。螯合（E错）是一种化学反应，不属于粘接方式的范畴。